应提出“建议暂缓结婚”的情况是
A. 软骨发育不全
B. 一方或双方患有重度、极重度智力低下神经衰弱
C. 细菌性阴道病
D. 艾滋病病毒携带者
E. 梅毒活动期

正确答案：E。梅毒活动期

解析：本题考查指定传染病与婚育的相关内容。在婚前医学检查中筛查病毒性肝炎、结核、性传播疾病以及艾滋病，如梅毒等在活动期内（E对ABCD错）的应暂缓结婚。